具有“善行数变”特点的邪气是
A. 风
B. 寒
C. 湿
D. 燥
E. 火

正确答案：A。风

解析：风性善动不居，游移不定，且风邪致病变幻无常，发病迅速，故说“风善行数变”。（A对）。寒邪（B错）是具有寒冷、凝结、收引特点的外邪，寒为阴邪，易伤阳气。湿邪（C错）是具有重着、黏滞、趋下特性的外邪，湿为阴邪，易伤阳气；湿性重浊；湿性黏滞，易阻气机；湿性趋下，易袭阴位。燥邪（D错）是具有干燥、收敛等特性的外邪，燥邪干涩，易伤津液；燥易伤肺。火邪（E错）是具有炎热升腾等特性的外邪，火热为阳邪，其性燔灼趋上；火热易扰心神；火热易伤津耗气；火热易生风动血；火邪易致阳性疮痈。